从任脉开始，由内向外的经脉排列是
A. 胃经.脾经.肾经
B. 胃经.肾经.脾经
C. 肾经.脾经.胃经
D. 肾经.胃经.脾经
E. 脾经.肾经.胃经

正确答案：D。肾经.胃经.脾经

解析：本题考查经脉的循行分布，属于记忆内容。任脉起于胞中，下出于会阴，经阴阜，沿腹部正中线上行，经咽喉部（天突穴），到达下唇内，左右分行，环绕口唇，交会于督脉之龈交穴，再分别通过鼻翼两旁，上至眼眶下（承泣穴），交于足阳明经。循行于腹胸面的经脉，自内向外依次为足少阴肾经、足阳明胃经、足太阴脾经和足厥阴肝经（D对）趣记：身为皮干，肾胃脾肝。